患者，男，40岁。既往有糖尿病史。小便频数，混浊如膏，甚至饮一溲一，耳轮干枯，腰膝酸软，四肢欠温，畏寒怕冷，阳痿，舌淡苔白，脉沉细无力。其证型是
A. 痰瘀互结
B. 气阴两虚
C. 阴虚燥热
D. 阴阳两虚
E. 脉络瘀阻

正确答案：D。阴阳两虚

解析：糖尿病证型可分为阴虚燥热证（肺热津伤证、胃热炽盛证、肾阴亏虚证、气阴两虚证、阴阳两虚证、痰瘀互结证、脉络瘀阻证。本题患者有糖尿病，肾失固藏，肾气独沉，故小便频数，混浊如膏；下元虚惫，约束无权，而至饮一溲一；水谷之精微随尿液下注，无以熏肤充身，残留之浊阴，未能排出，故面色黧黑不荣。肾主骨，开窍于耳，腰为肾之府，肾虚故耳轮焦干，腰膝酸软；命门火衰，宗筋弛缓，故见形寒畏冷，阳萎不举。舌淡苔白，脉沉细无力，是阴阳俱虚之象，所以该患者是阴阳两虚证（D对）；痰瘀互结证的症状为形体肥胖，胸脘腹胀，肌肉酸胀，四肢沉重或刺痛，舌暗或有瘀斑，苔厚腻，脉滑（A错）；气阴两虚证的症状为口渴引饮，能食与便溏并见，或饮食减少，精神不振，四肢乏力，体瘦，舌质淡红，苔白而干，脉弱（B错）；阴虚燥热证症状：上消（肺热津伤证）症状：烦渴多饮，口干舌燥，尿频量多，多汗，舌边尖红，苔薄黄，脉洪数。中消（热炽盛证）症状：多食易饥，口渴多饮，形体消瘦，大便干燥，舌红苔黄，脉滑实有力。下消（肾阴亏虚证）症状：尿频量多，混浊如脂膏，或尿有甜味，腰膝酸软，乏力，头晕耳鸣，口干唇燥，皮肤干燥、瘙痒，舌红少苔，脉细数（C错）；脉络瘀阻证症状为面色晦暗，消瘦乏力，胸中闷痛，肢体麻木或刺痛，夜间加重，唇紫，舌暗或有瘀斑，或舌下青筋紫暗怒张，苔薄白或少苔，脉弦或沉涩（E错）。